顾步汤适用于脱疽的何种证型
A. 热毒伤阴证
B. 寒湿阻络证
C. 血脉瘀阻证
D. 湿热毒盛证
E. 气血虚弱证

正确答案：A。热毒伤阴证

解析：脱疽热毒伤阴证适用于顾步汤（A对），寒湿阻络证适用于阳和汤（B错），血脉瘀阻证适用于桃红四物汤（C错），湿热毒盛证适用于四妙勇安汤（D错），气血虚弱证适用于黄芪鳖甲汤（E错）。